使囊心物高速穿过囊材的液态膜进入固化浴固化成囊的方法是
A. 复凝聚法
B. 喷雾冻凝法
C. 单凝聚法
D. 液中干燥法
E. 多孔离心法

正确答案：E。多孔离心法

解析：本题考查多孔离心法的定义。多孔离心法（E对）是指利用离心力使囊心物高速穿过囊材的液态膜，再进入固化浴固化微囊的制备方法。